固定义齿修复后引起基牙疼痛的原因为
A. 牙髓炎
B. 咬合早接触
C. 电位差刺激
D. 基牙受力过大
E. 以上说法均正确

正确答案：E。以上说法均正确

解析：引起基牙疼痛的原因不同，会导致基牙出现不同的临床表现：①咬合早接触；②牙周膜轻度损伤；③牙髓炎；④继发性龋；⑤电位差刺激；⑥基牙受力过大。掌握“固定桥修复后出现的问题及处理”知识点。